女孩，1岁。无不适，未接种过卡介苗。与父母生活在一起，其父患活动性肺结核，并时有咯血。胸部X线片无明显异常。PPD试验（+）。宜采取的措施是
A. 隔离观察
B. 接种卡介苗
C. 继续观察，暂不处理
D. 预防性抗结核治疗
E. 痰培养

正确答案：D。预防性抗结核治疗

解析：本例患者为一岁儿童，未接种过卡介苗，PPD试验阳性，而且长期与活动性结核病患者密切接触，患肺结核可能性非常大，需要进行预防性抗结核治疗（D对）。本例患儿感染结核杆菌的可能性非常大，仅仅隔离观察（A错）、继续观察，暂不处理（C错）对该患者不适用。接种卡介苗（B错）属于预防处理，在没有感染结核分枝杆菌之前可以采用。痰培养（E错）是确诊肺结核病的主要方法，若该患者有低热盗汗等结核中毒症状，可采用痰培养。